解表宜生用，平喘宜蜜炙用的药是
A. 桂枝
B. 麻黄
C. 紫苏
D. 青皮
E. 白果

正确答案：B。麻黄

解析：本题考查的是麻黄的用法用量。解表宜生用，平喘宜蜜炙用的药是麻黄（B对）。麻黄：【用法用量】内服：煎汤，1.5～10g；或入丸散。外用：适量，研末吹鼻，或研末敷。解表宜生用，平喘宜蜜炙用或生用。小儿、年老体弱者宜用麻黄绒。桂枝（A错）：【用法用量】内服：煎汤，3～10g；或入丸散。外用：适量，研末调敷，或煎汤熏洗。紫苏（C错）：【主治病证】（1）风寒感冒，咳嗽胸闷。（2）脾胃气滞证。（3）气滞胎动证。（4）食鱼蟹中毒引起的腹痛吐泻。青皮（D错）：【用法用量】内服：煎汤，3～10g；或入丸散。醋制疏肝止痛力强。白果（E错）：【用法用量】内服：煎汤，5～10g，打碎；或入丸散。生用毒性大，炒用毒性减弱。入药时须去除外层种皮及内层的薄皮和心芽。